慢性根尖周肉芽肿中央缺血而坏死、液化，可形成
A. 慢性根尖周肉芽肿
B. 急性牙槽脓肿
C. 急性牙周脓肿
D. 根尖周囊肿
E. 致密性骨炎

正确答案：B。急性牙槽脓肿

解析：本题考查急慢性根尖周炎。根尖周肉芽肿体积增大，营养难以抵达肉芽肿中心，肉芽肿中央组织可因缺血而坏死、液化，形成脓肿；向急性炎症转化，出现急性牙槽脓肿（B对）的症状。